具有杀虫、消积、行气、利水、截疟功效的药物是
A. 使君子
B. 苦楝皮
C. 槟榔
D. 雷丸
E. 榧子

正确答案：C。槟榔

解析：槟榔质重苦降，辛温行散，入胃与大肠经。善杀虫而力强，兼缓泻而促排虫体，治多种寄生虫病，最宜绦虫、姜片虫病者。能消积、行气、利水、截疟，治腹胀便秘、泻痢后重、水肿、脚气及疟疾（C对）。使君子（A错）的功效是杀虫消积。苦楝皮（B错）的功效是杀虫，疗癣。雷丸（D错）的功效是杀虫消积。榧子（E错）的功效是杀虫消积，润肺止咳，润燥通便。